碘缺乏病患病率特点是
A. 山区＞丘陵＞平原
B. 山区＞平原＞丘陵
C. 丘陵＞山区＞平原
D. 丘陵＞平原＞山区
E. 以上都不对

正确答案：A。山区＞丘陵＞平原

解析：本题考查碘缺乏病患病率特点。碘缺乏病是指从胚胎发育至成人期由于碘摄入量不足而引起的一系列病症。其患病率特点是：山区高于丘陵，丘陵高于平原，平原高于沿海。即山区＞丘陵＞平原（A对BCDE错）。